在中暑的几种类型中，以（）最为凶险
A. 热射病
B. 热痉挛
C. 热衰竭
D. 先兆中暑

正确答案：A。热射病

解析：本题考查热射病的发病机制。热射病（A对BCD错）是指在热环境下作业时，人体内部和外部总体热负荷超过了散热能力，导致身体过热所致。其临床特点为突然发病，体温升高可达40℃以上，开始时大量出汗，以后出现“无汗”，可伴有皮肤干热及意识障碍、嗜睡、昏迷等中枢神经系统症状。死亡率甚高。